乙状结肠起自左髂嵴，在下述部位续于直肠
A. 第5腰椎处
B. 第1骶椎处
C. 第2骶椎处
D. 第3骶椎处
E. 第4骶椎处

正确答案：D。第3骶椎处

解析：乙状结肠在第3骶椎处(D对)平面续于直肠。